由回结肠动脉分支供应的器官是
A. 阑尾
B. 胰
C. 直肠
D. 横结肠
E. 肛管

正确答案：A。阑尾

解析：阑尾（A对）、回肠末端、盲肠、升结肠均为由回结肠动脉分支供应的器官。